大咯血是指一日咯血量
A. 大于100mL
B. 大于200mL
C. 大于300mL
D. 大于400mL
E. 大于500mL

正确答案：E。大于500mL

解析：咯血是指喉部以下的呼吸器官出血，经咳嗽动作从口腔排出，引起咯血的原因很多，主要是以呼吸系统和循环系统疾病为主。大咯血是指咯血量超过500mL（E对）或一次咯血大于100mL者，大咯血是危及患者生命的急症，若血块阻塞呼吸道引起窒息则立即危及生命，窒息时，患者有濒死感觉，表情恐惧，喉头作响，随即呼吸减速甚至骤停，一侧或双侧呼吸音消失，全身皮肤发绀，神志不清。小咯血是指每日咯血量在100mL以内，中等量咯血是指咯血量在100-500mL之间者。